临床上在成人经常用于抽取红骨髓的骨是
A. 肱骨
B. 髂骨
C. 胫骨
D. 肋骨
E. 椎骨

正确答案：B。髂骨

解析：椎骨（E错）、骼骨、肋骨（D错）、胸骨以及肱骨（A错）和股骨等长骨的骺内终生存在红骨髓，临床常选骼前上棘或骼后上棘等处进行骨髓穿刺，检查骨髓象（B对）。